作用于DNA拓扑异构酶Ⅱ的半合成药物是
A. 喜树碱
B. 氟尿嘧啶
C. 环磷酰胺
D. 盐酸伊立替康
E. 依托泊苷

正确答案：E。依托泊苷

解析：本题考查依托泊苷。依托泊苷（E对）属于生物碱类拓扑异构酶Ⅱ的抑制剂。喜树碱（A错）为拓扑异构酶Ⅰ的抑制剂。氟尿嘧啶（B错）为尿嘧啶代谢物类抗肿瘤药物。环磷酰胺（C错）是在氮芥类抗肿瘤药。伊立替康（D错）是喜树碱的衍生物,特异的作用于拓扑异构酶Ⅰ。